淋病奈瑟菌的主要传播途径是
A. 呼吸道传播
B. 消化道传播
C. 创伤伤口感染
D. 性接触传播
E. 节肢动物叮咬

正确答案：D。性接触传播

解析：淋病奈瑟球菌所致疾病人类是淋病奈瑟菌唯一宿主，成人淋病主要经性接触传播。掌握“肠球菌属及奈瑟菌属”知识点。